医疗机构因临床急需进口少量药品，应向国务院药品监督管理部门提出申请，并持有
A. 《进口准许证》
B. 《进口药品注册证》
C. 《医药产品注册证》
D. 《医疗机构执业许可证》
E. 《进口许可证》

正确答案：D。《医疗机构执业许可证》

解析：本题考查药品管理。医疗机构因临床急需进口少量药品，应向国务院药品监督管理部门提出申请，并持有《医疗机构执业许可证》（D对）。进口麻醉药品和国家规定范围内的精神药品，必须持有国务院药品监督管理部门发给的《进口准许证》（A错）。《进口药品注册证》（B错）是国外企业生产的药品进口需要的。《医药产品注册证》（C错）是中国香港、澳门和台湾地区企业生产的药品进口时需要的。《进口许可证》（E错）是指商务部及其授权发证机构依法对实行数量限制或其他限制的进口货物颁发准予进口的许可证件。